精神卫生这一术语在国内外广泛应用的年代为
A. 20世纪50年代
B. 20世纪60年代
C. 20世纪70年代
D. 20世纪80年代
E. 20世纪90年代

正确答案：A。20世纪50年代